胆总管不扩张，胆囊增大，肝总管和肝内外胆管扩张。考虑为什么疾病
A. Mirizzi综合症
B. 胰头癌
C. 急性胆管炎
D. 肝门胆管癌
E. 肝内胆管结石

正确答案：A。Mirizzi综合症

解析：胆总管不扩张，胆囊增大，肝总管和肝内外胆管扩张为均为Mirizzi综合征（A对）的胆道影像检查，Mirizzi综合征又称肝管狭窄综合征，此类患者可反复出现发作性胆绞痛，可合并发热、皮肤巩膜黄染、尿色增深等胆管炎症的表现；胰头癌（B错）致胆道梗阻一般无胆道感染，可出现胆囊增大，不出现、肝总管扩张的症状；急性胆管炎（C错），是由于结石引起胆道阻塞，胆汁淤滞，感染造成胆管壁黏膜充血、水肿，加重胆管梗阻，反复的胆管炎使胆囊壁纤维化并增厚、狭窄，近端胆管扩张；肝门部胆管癌（D错），常表现为进行性黄疸、胆囊一般不肿大；肝内胆管结石（E错），ERCP可观察到胆管内结石负影、胆管狭窄及近端胆管扩张，肝总管不扩张。